主要作用于髓袢升支粗段皮质部和髓质部的利尿药是
A. 螺内酯
B. 氨苯蝶啶
C. 甘露醇
D. 呋塞米
E. 氢氯噻嗪

正确答案：D。呋塞米

解析：常用利尿剂有袢利尿剂、噻嗪类及类噻嗪类、保钾利尿剂、碳酸酐酶抑制剂和渗透性利尿剂。其中，主要作用于髓袢升支粗段皮质部和髓质部的利尿药是袢利尿剂包括呋塞米（D对）、依他尼酸、布美他尼。此类药物利尿作用的分子机制是特异性抑制髓袢升支管腔膜侧的Na⁺-K⁺ -2Cl⁻同向转运子，因而抑制NaCl的重吸收，产生利尿的效果。